急性红斑型念珠菌型口炎的临床表现是
A. 病损区黏膜充血，有散在的色白如雪的柔软小斑点
B. 病损区黏膜表现为结节状或颗粒状增生，或为固着紧密的白色角质斑块
C. 病损区黏膜呈亮红色水肿，或见斑点状假膜
D. 病损区黏膜充血糜烂，舌背乳头成团块萎缩，周围舌苔增厚
E. 病损区黏膜出现珠光白色网纹伴充血

正确答案：D。病损区黏膜充血糜烂，舌背乳头成团块萎缩，周围舌苔增厚

解析：本题考查口腔念珠菌病。急性红斑型念珠菌型口炎的临床表现是病损区黏膜充血糜烂，舌背乳头成团块萎缩，周围舌苔增厚（D对）。病损区黏膜充血，有散在的色白如雪的柔软小斑点（A错）是急性假膜型念珠菌菌口炎的临床表现。病损区黏膜表现为结节状或颗粒状增生，或为固着紧密的白色角质斑块（B错）是慢性肥厚型（增殖型）口腔念珠菌病的临床表现。病损区黏膜呈亮红色水肿，或见斑点状假膜（C错）是慢性红斑型（萎缩型）念珠菌病的临床表现。病损区黏膜出现珠光白色网纹伴充血（E错）是口腔扁平苔藓的临床表现。